患者，男，48岁，患有青光眼3年。今日因支气管哮喘急性发作，给于舒张支气管、抗炎等治疗，应告知该患者用药后需漱口的药物是
A. 多索茶碱注射液
B. 布地奈德混悬液
C. 孟鲁司特钠咀嚼片
D. 沙丁胺醇气雾剂
E. 异丙托溴铵气雾剂

正确答案：B。布地奈德混悬液

解析：本题考查药物的使用。用药后需漱口的药物是布地奈德混悬液（B对）。吸入型糖皮质激素通常规律吸入3～7天以上方能起效。少数患者可出现口咽白色念珠菌感染、声音嘶哑、吸药后用清水漱口可减轻局部反应和胃肠吸收，常用药物有倍氯米松、布地奈德、氟替卡松。多索茶碱（A错）对急性心肌梗死者禁用。白三烯受体阻断剂孟鲁司特（C错）对12对以下儿童、妊娠及哺乳妇女宜在权衡利弊后慎重应用。沙丁胺醇（D错）属于β₂受体激动剂，对心血管功能不全、高血压、甲状腺功能亢进患者及妊娠期妇女慎用，对老年人及对β₂受体激动剂敏感者慎用。异丙托溴铵（E错）对妊娠妇女慎用；对阿托品类药过敏者禁用；患有闭角型青光眼、良性前列腺增生者慎用。